麻杏甘草石膏汤的功用是
A. 解肌清热，祛痰止咳
B. 辛凉宣泄，清肺平喘
C. 解肌透热，降气平喘
D. 辛凉透表，清热解毒
E. 宣肺利气，清热止咳

正确答案：B。辛凉宣泄，清肺平喘

解析：麻杏甘草石膏汤的功用是辛凉宣泄，清肺平喘，为表邪入里化热，壅遏于肺，肺失宣降所致，主治外感风邪，邪热壅肺证，为治疗表邪未解，邪热壅肺之喘咳的基础方（B对）。解肌清热，祛痰止咳方用桑菊饮（A错）。解肌透热，降气平喘方用五磨饮子（C错）。辛凉透表，清热解毒方用银翘散（D错）。宣肺利气，清热止咳方用桑菊饮（E错）。